以下关于口腔癌的TNM分类的描述，不正确的是
A. T指原发肿瘤
B. T临床分期
C. N指区域性淋巴结
D. M指有无远处转移
E. 根据癌瘤侵犯的范围，制定的该分类

正确答案：B。T临床分期

解析：T是指原发肿瘤；N是指区域性淋巴结；M是指有无远处转移。掌握“口腔颌面部肿瘤的治疗原则及预防”知识点。